骨
A. 构成人体的外形
B. 分为躯干骨和四肢骨
C. 又称骨骼
D. 是一种器官
E. 成年损伤后不能再生

正确答案：D。是一种器官

解析：骨是以骨组织（包括骨细胞、胶原纤维和基质等）为主体构成的器官（D对）。骨折愈合初期，骨痴颇不规则，经过一定时间的吸收和改建，骨可基本恢复原有的形态结构（E错）。骨按部位可分为颅骨、躯干骨和四肢骨（B错）。